踝关节最薄弱的韧带是
A. 胫腓外韧带
B. 胫腓内韧带
C. 外侧副韧带
D. 内侧韧带
E. 足底长韧带

正确答案：C。外侧副韧带

解析：踝关节最薄弱的韧带是外侧副韧带（C对）。胫腓外韧带、胫腓内韧带构成胫腓骨的坚强连结（AB错）。内侧副韧带，是踝关节最坚强的韧带（D错）。足底长韧带是位于跖趾关节足底面的韧带（E错）。